泌尿系结石血尿是
A. 无痛性肉眼血尿
B. 终末血尿伴膀胱刺激症状
C. 初始血尿
D. 疼痛伴血尿
E. 血尿+蛋白尿

正确答案：D。疼痛伴血尿

解析：泌尿系结石血尿多为疼痛伴血尿（D对）。全程无痛性肉眼血尿（A错）常提示泌尿系肿瘤，尤其是中老年人。终末血尿伴膀胱刺激征（B错）为泌尿系结核的典型表现。初始血尿（C错）多见于后尿道、膀胱颈部出血。血尿+蛋白尿（E错）常见于肾小球肾炎。